Medicine指的是
A. 传统综述
B. 系统回顾
C. 系统综述
D. 循证医学
E. 叙述性综述

正确答案：D。循证医学

解析：本题考查循证医学。Evidence-based Medicine指的是循证医学（D对ABCE错），循证医学是有意识地、明确地、审慎地利用现有最好的证据制定关于个体患者的诊治方案。